朱砂中毒的主要临床表现
A. 恶心呕吐、口中有金属味；流涎；腹痛腹泻；口腔黏膜充血，牙龈肿胀溃烂
B. 胸闷；心悸；喉咙干痛；四肢无力；心电图显示房室传导阻滞
C. 头晕；头痛；烦躁不安；面部肌肉紧张；吞咽困难；伸肌与屈肌同时收缩
D. 严重脱水；低蛋白血症；水肿；精神错乱；幻觉；癫痫样发作
E. 口舌，四肢及全身麻木；头痛；头晕；精神恍惚；牙关紧闭；呼吸衰竭

正确答案：A。恶心呕吐、口中有金属味；流涎；腹痛腹泻；口腔黏膜充血，牙龈肿胀溃烂

解析：本题考查的是含朱砂、轻粉、红粉的中成药的中毒表现。轻粉中毒的主要临床表现是恶心呕吐、口中有金属味；流涎；腹痛腹泻；口腔黏膜充血，牙龈肿胀溃烂（A对）。含朱砂、轻粉、红粉的中成药的中毒表现：1.消化系统表现为恶心呕吐、腹痛腹泻、口中有金属味、流涎、口腔黏膜充血、牙龈肿胀溃烂等。2.泌尿系统表现为少尿、蛋白尿，严重者可发生急性肾功能衰竭。3.神经系统及精神方面症状。胸闷；心悸；喉咙干痛；四肢无力；心电图显示房室传导阻滞（B错）是蟾酥的中毒表现。蟾酥及含蟾酥的中成药的中毒表现：1.循环系统：表现为胸闷、心律失常、脉缓慢无力、心电图显示房室传导阻滞等。严重时面色苍白、口唇发绀、四肢厥冷、大汗虚脱、血压下降、休克，甚至心搏骤停而死亡。2.消化系统：表现为恶心呕吐、腹痛、腹泻等。头晕；头痛；烦躁不安；面部肌肉紧张；吞咽困难；伸肌与屈肌同时收缩（C错）是马钱子的中毒表现。马钱子及含马钱子的中成药的中毒表现：初期出现头晕、头痛、烦躁不安、面部肌肉紧张、吞咽困难；进而伸肌与屈肌同时做极度收缩，发生典型的士的宁惊厥、痉挛，甚至角弓反张，可因呼吸肌痉挛窒息或心力衰竭而死亡。严重脱水；低蛋白血症；水肿；精神错乱；幻觉；癫痫样发作（D错）是蓖麻子的的不良反应表现。蓖麻子的不良反应表现：蓖麻毒素经呼吸道吸入、消化道摄入和肌内注射均可致人中毒，潜伏期一般为4～8小时，临床主要表现如下。①消化系统：口麻、咽部烧灼感、恶心、呕吐、腹痛、腹泻、出血性胃肠炎，黄疸以及中毒性肝病等。②呼吸、循环系统：呼吸、循环衰竭。③网状内皮系统：严重脱水、低蛋白血症、水肿、毒血症、高热。④血液、泌尿系统：溶血；血便、血尿、少尿、尿闭等中毒性肾病。⑤神经系统：四肢麻木、步态不稳、烦躁不安、精神错乱、手舞足蹈、昏迷、幻觉、癫痫样发作。⑥有时可伴发过敏反应如口唇青紫、荨麻疹。口舌，四肢及全身麻木；头痛；头晕；精神恍惚；牙关紧闭；呼吸衰竭（E错）是乌头类药物的中毒表现。乌头类药物的中毒表现：1.神经系统：表现为口舌、四肢及全身麻木，头痛，头晕，精神恍惚，语言不清或小便失禁，继而四肢抽搐、牙关紧闭、呼吸衰竭等。2.循环系统：表现为心悸气短、心律失常、血压下降、面色苍白、口唇发绀、四肢厥冷等。3.消化系统：表现为流涎、恶心、呕吐、腹痛、腹泻、肠鸣音亢进。